人体测量最主要的目的是
A. 了解职业人群的身体状况
B. 为工作场所和机器设备的设计提供依据
C. 确定是否有职业有害因素影响作业人群的发育
D. 确定是否有职业有害因素影响作业人群的健康
E. 确定此工作是否适合此人群参与

正确答案：B。为工作场所和机器设备的设计提供依据